患者，女，23岁，已婚。孕后心烦少寐，渴喜冷饮，腰酸腹痛，伴阴道少量出血，舌红苔黄，脉滑数。治疗应首选
A. 淸热固经汤
B. 保阴煎
C. 加味阿胶汤
D. 加味圣愈汤
E. 以上均非

正确答案：B。保阴煎

解析：妊娠期间出现腰痛、腹痛、小腹下坠，或伴有少量阴道出血者，称为“胎动不安”。热邪直犯冲任、子宫，内扰胎元，胎元不固，故出现阴道少量出血，热邪耗伤津液，故出现渴喜冷饮，热邪内扰，胎气不安，胎系于肾，腰为肾之府，故出现腰酸，热扰心神，阳不入阴，故出现心烦少寐，舌红苔黄，脉滑数均为血热之症，故题中所述“孕后心烦少寐，渴喜冷饮，腰酸腹痛，伴阴道少量出血，舌红苔黄，脉滑数”属于胎动不安 血热证，方用保阴煎以养血健脾，清热安胎（B对）。清热固经汤清热凉血，固冲止血，用以治疗崩漏之实热证（A错）。加味阿胶汤为干扰选项（C错）。加味圣愈汤养血安胎，用于治疗妊娠伤胎，腹痛不下血者（D错）。